药物过敏性口炎时机体产生的抗体是
A. IgA
B. IgG
C. IgM
D. IgD
E. IgE

正确答案：E。IgE

解析：本题考查Ⅰ型变态反应。药物过敏性口炎属于Ⅰ型超敏反应，其介导物质是肥大细胞和IgE（E对）。IgA（A错）和IgM（C错）抗体介导Ⅲ超敏反应，一些目前原因尚不明确的结缔组织病、肉芽肿性疾病及反复发作的溃疡等均可能与此型超敏反应有关。IgG（B错）或IgM抗体介导Ⅱ超敏反应，临床常见的疾病如粒细胞减少症、血小板减少性紫癜等属于此型反应性疾病。